关于社区健康教育与健康促进的表述，不正确的是
A. 以社区为单位
B. 以社区人群为教育对象
C. 以促进社区居民健康为目标
D. 有组织、计划、有评价的健康教育活动
E. 以社区医疗机构为单位

正确答案：E。以社区医疗机构为单位